牙髓包括
A. 纤维
B. 血管
C. 神经
D. 淋巴管
E. 以上均包括

正确答案：E。以上均包括

解析：牙髓是疏松结缔组织，它包含有细胞、纤维、神经、血管、淋巴管和其他细胞外基质。掌握“牙髓”知识点。